以下不属于钙的功能的是
A. 持神经肌肉的兴奋性
B. 参与外源性和内源性凝血过程
C. 细胞钙离子的分布和转移是形成钙信号产生的基础
D. 参与体内酸碱平衡的调节
E. 保证骨骼的正常生长发育

正确答案：D。参与体内酸碱平衡的调节

解析：骨骼和牙齿是人体中含钙最多的组织，钙是构成骨骼的重要成分。钙对于保证骨骼的正常生长发育和维持骨健康起着至关重要的作用。钙维持神经肌肉的兴奋性，包括肌肉的兴奋、神经元与神经元之间以及神经元与效应细胞之间的信息传递、心脏的正常搏动。细胞内钙离子是重要的第二信使，细胞钙离子的分布和转移是形成钙信号产生的基础。钙离子是凝血因子Ⅳ，参与了外源性和内源性凝血过程。D选项参与体内酸碱平衡的调节是磷的功能。掌握“钙、磷、氟”知识点。